肱骨髁上骨折后出现手指不能内收外展，夹纸试验阳性，最可能损伤的神经是
A. 腋神经
B. 正中神经
C. 桡神经
D. 肌皮神经
E. 尺神经

正确答案：E。尺神经

解析：肱骨髁上骨折发生尺侧或桡侧移位时，可造成尺神经或桡神经损伤。尺神经（E对）损伤（P701）导致骨间肌、拇收肌和3、4蚓状肌等麻痹，可出现爪形手畸形、手指内收、外展障碍（夹纸试验阳性）和Froment征等表现。桡神经（C错）损伤（P701）典型表现为垂腕、垂指、垂拇畸形。腋神经（A错）损伤主要见于肱骨外科颈骨折。正中神经（B错）损伤（P700）主要见于肱骨髁上骨折，表现为前臂旋前障碍，屈腕无力，拇、示指和中指屈曲障碍，拇指对掌功能障碍，“猿手”（鱼际肌萎缩，手掌平坦）畸形等。肌皮神经（D错）损伤可见于肱骨上中段骨折，表现为屈肘无力以及前臂外侧部分皮肤感觉减弱。